链球菌感染后急性肾小球肾炎的病理类型为
A. 微小病变肾病
B. 新月体性肾小球肾炎
C. IgA肾病
D. 毛细血管内增生性肾小球肾炎
E. 膜性肾病

正确答案：D。毛细血管内增生性肾小球肾炎

解析：链球菌感染后急性肾小球肾炎即急性弥漫性增生性肾小球肾炎，其病理类型为毛细血管内增生性肾小球肾炎（D对）。微小病变肾病（A错）和膜性肾病（E错）均为肾病综合征的病理类型。新月体性肾小球肾炎（B错）（P267）又称急进性肾小球肾炎，以新月体形成为病变特点。IgA肾病（C错）最常见的病理类型是系膜增生性病变（P272）。